下列属于人畜共患病的是
A. 流行性脑脊髓膜炎
B. 流行性乙型脑炎
C. 细菌性痢疾
D. 乙型肝炎
E. 伤寒

正确答案：B。流行性乙型脑炎